除发表解肌外，又能生津的药是
A. 柴胡
B. 葛根
C. 升麻
D. 蔓荆子
E. 淡豆豉

正确答案：B。葛根

解析：本题考查的是葛根的功效。除发表解肌外，又能生津的药是葛根（B对）。葛根：【功效】解肌退热，透疹，生津，升阳止泻。柴胡（A错）：【功效】解表退热，疏肝解郁，升举阳气。升麻（C错）：【功效】发表透疹，清热解毒，升举阳气。蔓荆子（D错）：【功效】疏散风热，清利头目，祛风止痛。淡豆豉（E错）：【功效】解表，除烦。